对眼猪囊尾蚴病患者首选的治疗是
A. 阿苯达唑
B. 吡喹酮
C. 氯喹
D. 伯氨喹
E. 手术

正确答案：E。手术

解析：阿苯达唑是目前治疗重型脑囊尾蚴病的首选药物，对皮下组织和肌肉、脑囊尾蚴病均有良好疗效（A错）。吡喹酮可穿过囊尾蚴的囊壁，具有强烈杀死囊尾蚴的作用，疗效较阿苯达唑强而迅速，不良反应发生率高且严重（B错）。氯喹、伯氨喹（P285）是常用抗疟药，不用来治疗囊尾蚴病（CD错）。对眼猪囊尾蚴病患者首选的治疗是手术（P339）（E对）。